B淋巴细胞主要定居在淋巴结的哪个区域
A. 皮质区
B. 深皮质区
C. 浅皮质区
D. 副皮质区
E. 髓窦

正确答案：C。浅皮质区